上颌总义齿牙槽嵴与硬区之间的区域是
A. 主承托区
B. 副承托区
C. 缓冲区
D. 边缘伸展区
E. 边缘封闭区

正确答案：B。副承托区

解析：本题考查无牙颌的功能分区。上颌总义齿牙槽嵴与硬区之间的区域是副承托区（B对）。无牙颌依据其生理特点分主承托区、副承托区、边缘封闭区和缓冲区。主承托区（A错）是指上下牙槽嵴顶区。副承托区指上下颌牙槽嵴的唇颊和舌腭侧（不包括上颌硬区），位于牙槽嵴与硬区之间。边缘封闭区（E错）是指牙槽嵴黏膜与唇颊舌黏膜的反折线区和上颌后堤区、下颌磨牙后垫区。缓冲区（C错）是指上颌硬区和下颌隆突区。